矽肺的X线表现有
A. 类圆形小阴影
B. 不规则形小阴影
C. 大阴影
D. 胸膜和肺门改变
E. 以上全有

正确答案：E。以上全有

解析：本题考查的是矽肺的X线临床表现。在X线下，不同进程的矽肺有着不同的状态，圆形小阴影是矽肺最常见和最重要的一种X线表现形态。接触游离SiO₂会在X线表现出不规则形小阴影。晚期矽肺的重要表现是会出现长径超过10mm的大阴影。同时还会引起胸膜变化，肺气肿，肺门和肺纹理变化（E对ABCD错）。